中风，厥证，痫病的共同特点是
A. 半身不遂，肢体麻木
B. 突然昏仆，不省人事
C. 语言不利，口眼歪斜
D. 四肢厥冷，气息微弱
E. 口吐涎沫，四肢抽搐

正确答案：B。突然昏仆，不省人事

解析：本题主要考查中风、厥证、痫病的共同特点。中风是以猝然昏仆，不省人事，半身不遂，口眼歪斜，语言不利为主证的病证。厥证是以突然昏倒，不省人事，四肢逆冷为主要临床表现的病证。痫病是以突然意识丧失，甚则仆倒，不省人事，强直抽搐，口吐涎沫等为主要特征的病证。因此三者的共同特点是突然昏仆，不省人事（B对）。